多柔比星
A. 心脏毒性最大
B. 肾脏毒性最大
C. 对肺脏毒性最大
D. 对骨髓抑制最重
E. 发生腹泻最重

正确答案：A。心脏毒性最大